检测黄曲霉素的方法是
A. 高效色谱检测
B. 气相色谱检测
C. 薄层色谱检测
D. 分光光度检测
E. 原子检测

正确答案：A。高效色谱检测

解析：本题考查的是高效液相色谱法法。检测黄曲霉素的方法是高效色谱检测（A对）。黄曲霉毒素的检查：黄曲霉毒素为黄曲霉等的代谢产物，是强烈的致癌物质。各国对食品和药品中黄曲霉毒素的限量都作了严格的规定，但目前还没有公认的植物药中黄曲霉毒素的限量标准。《中国药典》采用高效液相色谱法，结合柱后衍生法和高效液相-串联质谱法测定药材、饮片及制剂中的黄曲霉毒素。气相色谱法（B错）最适用于含挥发油及其他挥发性成分的药材及中成药的分析，用于药品的鉴别、杂质检查、水分测定、农药残留量测定和含量测定。薄层色谱法（C错）因其快速、简便和灵敏，是目前中药鉴定中用于定性鉴别使用最多的色谱法之一。可见分光光度法（D错）是比较溶液颜色深度以确定物质含量的方法。原子吸收分光光度法（E错）的特点为专属性强，检测灵敏度和精密度均高，测定速度快，是目前用于测定中药中重金属及有害元素、微量元素最常用的方法。